以下各种生产性因素中，除了哪一类外，均为非电离辐射
A. 激光
B. 微波
C. X射线
D. 紫外线
E. 红外线

正确答案：C。X射线

解析：本题考查非电离辐射的种类。量子能量较低的电磁辐射不足以引起生物体电离，称为非电离辐射，如紫外线（D对）、可见光、红外线（E对）、射频及来源于可见光的激光（A对）。微波（B对）也属于非电离辐射。X射线（C错，为本题正确答案）属于电离辐射。